小柴胡颗粒既能疏肝和胃，又能
A. 健脾消食
B. 解表散热
C. 疏肝解郁
D. 疏肝清热
E. 消胀止痛

正确答案：B。解表散热

解析：本题考查的是小柴胡颗粒的功能。小柴胡颗粒既能疏肝和胃，又能解表散热（B对）。小柴胡颗粒：【功能】解表散热，疏肝和胃。健脾消食丸：【功能】健脾，和胃，消食（A错），化滞。解郁安神颗粒：【功能】疏肝解郁（C错），安神定志。加味逍遥丸：【功能】疏肝清热（D错），健脾养血。柴胡舒肝丸：【功能】疏肝理气，消胀止痛（E错）。